4岁男孩，右侧阴囊包块，质软，透光试验阳性，平卧后可消失，正确的诊断是
A. 右侧睾丸鞘膜积液
B. 右侧交通性鞘膜积液
C. 右侧斜疝
D. 右侧睾丸肿瘤
E. 右侧附睾结核

正确答案：B。右侧交通性鞘膜积液

解析：男性患儿，右侧阴囊包块、质软、透光试验阳性（提示鞘膜积液），平卧后可消失（提示为交通性鞘膜积液），结合患儿的病史和体查，应诊断为右侧交通性鞘膜积液（B对）。睾丸鞘膜积液（A错）的临床表现与交通性鞘膜积液相似，但阴囊肿块在平卧位时不会消失。腹股沟斜疝（P308）（C错）形成的阴囊肿块平卧位时肿块可回纳而消失，但透光试验阴性。睾丸肿瘤（D错）为实质性肿块，质地坚硬，患侧睾丸有沉重感，透光试验呈阴性。附睾结核（P548）（E错）主要表现为阴囊部肿胀不适或下坠感，查体常可触及串珠样、粗硬的输精管，透光试验阴性。